成瘾行为与依赖性联系密切的4个方面表现不包括
A. 心理依赖
B. 精神依赖
C. 躯体依赖
D. 耐受性
E. 戒断症状

正确答案：B。精神依赖

解析：本题考查成瘾行为与依赖性联系密切的4个方面。成瘾行为与依赖性联系密切的4个方面表现是：①心理依赖（A对）；②躯体依赖（C对）；③耐受性（D对）；④戒断症状（E对）。精神依赖（B错，为本题正确答案）不属于成瘾行为与依赖性联系密切的表现。